不属于医学伦理学原则的是
A. 尊重原则
B. 不伤害原则
C. 知情同意原则
D. 公正原则
E. 有利原则

正确答案：C。知情同意原则

解析：“四原则说”由比彻姆和查尔瑞斯在其合著的《生物医学伦理学原理》一书中提出和阐释。他们认为，自主原则、不伤害原则、行善原则、公正原则是生命伦理的基本原则。生命伦理四原则传入我国后，逐渐成为教科书中的主要内容，并被列为国家医师资格考试的内容，所不同的是，其中的自主原则被改称为尊重原则，行善原则被改称为有利或有益原则。因此，医学伦理学原则包括有利原则（E对）、公正原则（D对）、不伤害原则（B对）和尊重原则（A对），不包括知情同意（C错，为本题正确答案）原则。